最可能引起左心室前负荷增加的是
A. 二尖瓣狭窄
B. 肺动脉瓣狭窄
C. 主动脉瓣关闭不全
D. 主动脉瓣狭窄
E. 体循环动脉高压

正确答案：C。主动脉瓣关闭不全

解析：主动脉瓣关闭不全时，舒张期主动脉内血流可大量反流入左心室，使左心室舒张末期容量增加，从而引起左心室前负荷增加（C对）。二尖瓣狭窄（A错）舒张期左心房流入左心室血流减少，使左心室舒张末期容量减少，左心室前负荷会降低。肺动脉瓣狭窄（B错）时，右心室射血受阻，后负荷增加，肺循环血量减少，舒张期左心房流入左心室血流也相应减少，左心室舒张末期容量减少，引起左心室前负荷降低。主动脉瓣狭窄（D错）和体循环动脉高压（E错）主要引起左心室后负荷（压力负荷）增加，而不是前负荷增加。